龈上牙石易沉积于
A. 后牙邻面和前牙唇面
B. 全口牙邻面
C. 全口牙颊舌面
D. 上磨牙颊面和下前牙舌面
E. 下磨牙颊面和上前牙舌面

正确答案：D。上磨牙颊面和下前牙舌面

解析：本题考查龈上结石。龈上牙石易沉积于上磨牙颊面和下前牙舌面（D对）。沉积在临床牙冠，直接可看到的牙石称为龈上牙石，呈黄色或白色。龈上牙石易沉积于上颌第一磨牙颊面和下前牙舌面，因为它们分别与腮腺导管开口和舌下腺导管口相对。